高血压病最严重的病变是
A. 左心室肥大
B. 颗粒性固缩肾
C. 脑软化
D. 脑出血
E. 视网膜出血

正确答案：D。脑出血

解析：高血压病引起的脑细小动脉硬化可造成局部组织缺血，毛细血管通透性增加，从而导致一系列脑病变，如脑水肿、脑软化（C错）和脑出血等。其中脑出血（D对）是最严重的病变，往往是致命的。左心室肥大（A错）、颗粒性固缩肾（B错）和视网膜出血（E错）均为高血压病的并发症，但严重程度均不及脑出血。